患者，男，36岁。5天前发热、咽痛，应用抗生素治疗无效，颈部浅表淋巴结肿大，咽部充血。扁桃体Ⅱ肿大，下肢少许瘀斑。化验：血红蛋白80g/L，白细胞16.0×10⁹/L，血小板34×10⁹/L，骨髓象：原始细胞占0.6。在进行体格检查时应特别注意的体征是
A. 睑结膜苍白
B. 胸骨压痛
C. 浅表淋巴结肿大
D. 皮肤出血点.
E. 心脏杂音

正确答案：B。胸骨压痛

解析：患者，男，36岁。5天前发热、咽痛，应用抗生素治疗无效（排除细菌感染的因素），颈部浅表淋巴结肿大，咽部充血。扁桃体Ⅱ肿大，下肢少许瘀斑（说明有出血表现）。化验：血红蛋白80g/L（男性正常范围：120 ～160g/L），白细胞16.0×10⁹L（正常范围：4～10×10⁹/L），血小板34×10⁹L（正常范围：100～300×10⁹L），骨髓象：原始细胞占0.6（原始细胞比例超过30%，通常被认为是急性白血病的主要诊断标准）。该病人发病急，有发热、贫血、出血的表现，血中白细胞明显增多，原始细胞比例显著增加，应考虑为急性白血病（P571）。在进行体格检查时应特别注意的体征是胸骨压痛（B对），这是白血病细胞增殖浸润的表现（P571），是由白血病细胞增殖造成骨髓压力增高，以及白血病细胞浸润骨膜刺激感觉神经而引起的，以胸骨中下段压痛最为显著。胸骨压痛是白血病的重要体征之一。睑结膜苍白（A错）、浅表淋巴结肿大（C错）、皮肤出血点（D错）、心脏杂音（E错）虽然也会出现在白血病的病情中，但并不是白血病的重要体征。